关于非附着性龈下菌斑，以下描述哪一项是不正确的
A. 在某些条件下，非附着性龈下菌斑的量大大增加
B. 其构成以厌氧菌为主
C. 与牙槽骨的破坏密切相关
D. 导致根面龋
E. 结构松散，直接与袋上皮和龈沟且接触

正确答案：D。导致根面龋

解析：本题考查非附着性龈下菌斑的特性。关于非附着性龈下菌斑不正确的是导致根面龋（D错，为本题的正确答案）。非附着性龈下菌斑指龈缘以下位于附着性龈下菌斑表面或直接与龈沟上皮、袋内上皮接触的龈下菌斑，结构松散，直接与袋上皮和龈沟相接触（E对）,常导致牙槽骨快速破坏（C对）、牙周炎。被认为是牙周炎的“进展前沿”。根面龋是由附着性龈下菌斑导致的在口腔卫生不佳的情况下，非附着性龈下菌斑的量大大增加（A对），加快了牙槽骨破坏的速度。其构成以厌氧菌为主（B对），因为菌斑位于龈下，而龈下为缺氧环境，其优势菌是革兰阴性菌和活动菌。